在自然疫源地和可能是自然疫源地的地区兴办的大型建设项目开工前，建设单位应当申请当地卫生防疫机构对施工环境进行
A. 环保调查
B. 卫生调查
C. 卫生资源调查
D. 环境资源调查
E. 危害因素调查

正确答案：B。卫生调查

解析：在国家确认的自然疫源地计划兴建水利、交通、旅游、能源等大型建设项目的，应当事先由省级以上疾病预防控制机构对施工环境进行卫生调查。掌握“传染病的预防”知识点。